C型行为在发病中起重要作用的疾病是
A. 高血压
B. 胃溃疡
C. 糖尿病
D. 乳腺癌
E. 支气管哮喘

正确答案：D。乳腺癌

解析：行为医学界认为“C型行为”与癌症的发生相关。研究显示，“C型行为”者存在免疫功能低下的现象。掌握“心身疾病”知识点。